某药厂生产的藿香祛暑胶囊具有祛暑化湿，解表和中功效。其药物组成为广藿香、香薷、白芷、紫苏叶、苍木、丁香、陈皮、大腹皮、法半夏、茯苓、生姜、甘草，辅料为甘油、植物油、明胶、蜂蜡、食用色素。方中法半夏制备时，应选用的辅料是
A. 生姜、明矾
B. 甘草、皂角
C. 甘草、生石灰
D. 黑豆、豆腐
E. 甘草、金银花

正确答案：C。甘草、生石灰

解析：本题考查的是法半夏的炮制辅料。方中法半夏制备时，应选用的辅料是甘草、生石灰（C对）。半夏：【炮制方法】处方用品有生半夏、清半夏、姜半夏、法半夏。①生半夏：取原药材，除去杂质，洗净，干燥，用时捣碎。②清半夏：取净半夏，大小分开，用8%白矾溶被浸泡至内无干心，口尝微有麻舌感，取出，洗净，切厚片，干燥。每100kg净半夏，用白矾20kg。③姜半夏：取净半夏，大小分开，用水浸泡至内无干心，取出，另取生姜切片煎汤，加白矾（A错）是与半夏共煮至透心，取出，晾干，或晾至半干，干燥；或切薄片，干燥。每100kg净半夏，用生姜25kg，白矾12.5kg。④法半夏：取净半夏，大小分开，用水浸泡至内无干心，取出，另取甘草适量，加水煎煮二次，合并煎液，倒入用适量石灰水配制的石灰液中，搅匀，加入上述已浸透的半夏，浸泡，每日搅拌1～2次，并保持浸液pH在12以上，至切面黄色均匀，口尝微有麻舌感时，取出，洗净，阴干或烘干。每100kg净半夏，用甘草15kg，生石灰10kg。炮制时，选用甘草、皂角（B错），黑豆、豆腐（D错）或甘草、金银花（E错）为辅料的中药，2022年考试指南未明确说明。